下列人体实验类型中，不需要付出道德代价的是
A. 自体实验
B. 自愿实验
C. 欺骗实验
D. 强迫实验
E. 天然实验

正确答案：E。天然实验

解析：天然实验是指人体实验的整个设计、过程、手段和后果都不是出自实验者的意愿，也不受实验者的控制和干预，是在自然现象发生（如战争、瘟疫、地震等）过程中进行的，天然实验由于不损害受试者的自主性，有得无失，符合社会公正，其正当性是十分充分的，故不需要付出道德代价（E对）。而自体实验（A错）、自愿实验（B错）有可能损害受试者的利益，故需要付出道德代价。欺骗实验（C错）、强迫实验（D错）为不正当的人体实验，需要付出道德代价。